不把自己当病人，仍坚持工作是患者角色的
A. 角色行为缺如
B. 角色行为冲突
C. 角色行为减退
D. 角色行为强化
E. 角色行为异常

正确答案：A。角色行为缺如

解析：病人角色适应不良（E错）是指病人不能顺利地完成角色转变的过程。常见的角色适应不良有角色行为缺如、角色行为冲突、角色行为减退、角色行为强化、角色行为异常。角色行为缺如（A对）是指病人未能进入病人角色，不承认自己是病人。角色行为冲突（B错）是指当多种社会地位和多种角色集于一人时，在其自身内部产生的冲突。个体在适应病人角色过程中，与其病前的各种角色发生心理冲突而引起行为的不协调。角色行为减退（C错）指个体进入病人角色后，由于某种原因又重新承担起本应免除的社会角色的责任，放弃了病人角色去承担其他角色的活动。角色行为强化（D错）是指个体“安于”病人角色的现状，角色的行为与其躯体症状不相吻合，过分地对自我能力表示怀疑、失望和忧虑，行为上表现出较强的退缩和依赖性。